与铸造全冠相比，3/4冠的主要优点不包括
A. 强度好
B. 龈缘刺激小
C. 粘固时易就位
D. 可保留一个牙面
E. 美观

正确答案：A。强度好

解析：3/4冠强度没有铸造全冠强度好，3/4冠的主要优点是：磨牙少，粘固时易就位，龈缘刺激小，美观等。掌握“部分冠”知识点。